海金沙的功效是
A. 利水渗湿，健脾
B. 利水渗湿，退黄
C. 利尿通淋，止泻
D. 利尿通淋，清心
E. 利尿通淋，止痛

正确答案：E。利尿通淋，止痛

解析：本题考查的是海金沙的功效。海金沙的功效是利尿通淋，止痛（E对）。海金沙：【功效】利尿通淋，止痛。茯苓：【功效】利水渗湿，健（A错）脾，安神。金钱草：【功效】利水通淋，除湿退黄（B错），解毒消肿。车前子：【功效】利水通淋，渗湿止泻（C错），明目，清肺化痰。灯心草：【功效】利尿通淋，清心（D错）除烦。